体内甘油三酯的合成部位是
A. 神经细胞
B. 脂肪细胞
C. 肾细胞
D. 脾细胞
E. 乳腺细胞

正确答案：B。脂肪细胞

解析：甘油三酯合成的主要场所是肝、脂肪细胞和小肠。小肠以甘油一酯途径合成甘油三酯，肝和脂肪细胞（ B对）以甘油二酯途径合成甘油三酯。神经细胞（A错）、肾细胞（C错）、脾细胞（D错）、乳腺细胞（E错）均不能合成甘油三酯。